一小儿发烧后，左下肢不能作随意运动，肌张力减弱，腱反射消失，考虑损害部位在
A. 左侧皮质脊髓侧束
B. 右侧皮质脊髓侧束
C. 左侧腰、骶髓前角
D. 右侧腰、骶髓前角
E. 以上都不是

正确答案：C。左侧腰、骶髓前角

解析：下运动神经元损伤后的瘫痪表现为：随意运动障碍；肌张力降低，故又称弛缓性瘫痪（软瘫），由于神经营养障碍，还导致肌萎缩；腱反射消失。小儿左下肢不能作随意运动，肌张力减弱，腱反射消失，考虑损害部位在下运动神经元，而下运动神经元为脑神经一般躯体和特殊内脏运动核和脊髓前角的运动神经细胞，所以损伤部位在左侧腰、骶髓前角（C对）。